以下关于翼下颌间隙解剖特点的描述中，正确的是
A. 前界为颞肌及颊肌
B. 后界为腮腺
C. 向上与颞下间隙及颞间隙通连
D. 间隙内有舌神经、下牙槽神经和下牙槽动、静脉通过
E. 以上均正确

正确答案：E。以上均正确

解析：翼下颌间隙（翼颌间隙）位于下颌支与翼内肌之间。前界为颞肌及颊肌，后界为腮腺，上界为翼外肌下缘，下以翼内肌附着于下颌支处为界。间隙内主要有舌神经、下牙槽神经和下牙槽动、静脉通过。翼下颌间隙向上与颞下间隙及颞间隙通连，向前通颊间隙，向下与舌下、下颌下间隙相通，向后与咽旁间隙相通，向外通咬肌间隙。尚可经颅底血管神经通颅内。掌握“面侧深区及颌面部各间隙的境界”知识点。